女，40岁。闭经、溢乳半年。磁共振发现垂体1.5cm×1.0cm占位病变。需做激素检查，下列无助于诊断的检查是
A. 泌乳素
B. 生长激素
C. 促肾上腺皮质激素
D. 血管加压素
E. 促甲状腺激素

正确答案：D。血管加压素

解析：中年女性患者，闭经泌乳半年，磁共振发现垂体1.5cm×1.0cm占位病变，疑为垂体肿瘤引起的垂体性闭经（P354），需检查激素辅助诊断。位于蝶鞍内的腺垂体各种腺细胞均可发生肿瘤，肿瘤可分泌激素抑制GnRH分泌和（或）压迫分泌细胞，使促性腺激素分泌减少，继而可出现闭经及相应症状。腺垂体腺细胞包括泌乳素腺细胞（A对）、生长激素腺细胞（B对）、促肾上腺皮质激素腺细胞（C对）及促甲状腺激素腺细胞（E对）。而血管加压素（D错，为本题正确答案）是由下丘脑分泌的，无助于腺垂体肿瘤的诊断。